老年人服用含有盐酸伪麻黄碱的抗感冒药后，可致的不良反应是
A. 蛋白尿
B. 血压升高
C. 肺栓塞
D. 胃出血
E. 低血糖

正确答案：B。血压升高

解析：本题考查伪麻黄碱的不良反应。血压升高（B对）是老年人服用含有盐酸伪麻黄碱的抗感冒药后的不良反应之一。伪麻黄碱可引起血管收缩，造成血压升高。